洞的基本结构包括
A. 洞壁和洞角
B. 洞壁和洞缘
C. 洞壁和洞角，洞缘
D. 洞壁和洞角，洞缘，洞底

正确答案：C。洞壁和洞角，洞缘

解析：本题考查窝洞的结构。洞基本结构包括洞壁和洞角，洞缘（C对）。窝洞的洞壁分为侧壁和髓壁。洞壁相交形成洞角，分线角和点角，两壁相交形成线角，三壁相交形成点角。窝洞的侧壁与牙面相交构成的边缘称为洞缘，是由洞侧壁与牙面相交形成的线角，即洞缘角或洞面角。